铬酸盐制造工人所患法定职业肿瘤为
A. 皮肤癌
B. 肺癌
C. 前列腺肿瘤
D. 白血病
E. 间皮瘤

正确答案：B。肺癌

解析：本题考查铬酸盐的致癌种类。铬的毒性取决于氧化状态及溶解度，三价铬是一种生命必需微量元素，而溶解度小的六价铬可经呼吸道进入肺中导致肺癌（B对ACDE错）。铬酸盐制造工肺癌诊断细则：①原发性肺癌临床诊断明确；②有明确的六价铬化合物职业暴露史；③六价铬化合物累计暴露年限l年以上（含1年）；④潜隐期4年以上（含4年）。